被用于HIV感染和艾滋病的辅助诊断指标是
A. 检测CD2⁺T细胞数目
B. 检测CD3⁺T细胞数目
C. 检测CD4⁺T细胞数目
D. 检测CD8⁺T细胞数目
E. 检测CD28⁺T细胞数目

正确答案：C。检测CD4⁺T细胞数目

解析：检测CD4⁺T细胞数目被用于HIV感染和艾滋病的辅助诊断指标。掌握“白细胞分化抗原及黏附分子”知识点。